患者，男，17岁。感冒后15天出现原因不明的低热，多汗，食欲不振，乏力和关节肿痛，舌红苔黄腻，脉滑数。应首先考虑的是
A. 风湿热痹
B. 风寒湿痹
C. 尪痹
D. 肺痨
E. 肺痈

正确答案：A。风湿热痹

解析：本题患者由于外感风邪故低热，多汗，脾虚多湿则食欲不振，乏力，热邪伤津，灼伤经络则关节肿痛，湿热蕴结则苔黄腻脉滑数，故须清热通络，祛风除湿，方用白虎加桂枝汤或宣痹汤加减（A对）。风寒湿痹症状：关节肌肉肿胀疼痛，游走不定；或痛有定处，遇寒则痛剧，局部畏寒怕冷；或关节肿胀重着，肌肤麻木不仁，晨僵，关节屈伸不利。舌淡，舌苔薄白或白腻，脉弦紧或濡缓（B错）。尪痹，关节剧痛、肿大、僵硬变形、屈伸不利，是多种痹症最终的发展结局（C错）。肺痨是以咳嗽，咯血，潮热，盗汗及身体逐渐消瘦为主要表现的病症（D错）。肺痈是以咳嗽，胸痛，发热，咳吐腥臭浊痰，甚则脓血相兼为主要表现的病症（E错）。